伤寒治疗首选
A. 链霉素
B. 青霉素
C. 氯霉素
D. 环丙沙星
E. 四环素

正确答案：D。环丙沙星

解析：伤寒感染导致的肠热症治疗早期使用的是氯霉素（C错），但由于氯霉素具有骨髓抑制作用且出现耐药株，引而不作为首选，临床开始使用其他药物代替，目前，环丙沙星（D对）为主要治疗伤寒的药物，作为首选。链霉素（A错）一般应用于结核分枝杆菌感染的治疗。青霉素（B错）是治疗链球菌感染、钩端螺旋体病的首选药物。四环素（E错）用于支原体、衣原体、立克次氏体等的治疗。